结构中氮原子不在环状结构内的生物碱是
A. 麻黄碱
B. 槲皮素
C. 小檗碱
D. 东莨菪碱
E. 青蒿素

正确答案：A。麻黄碱

解析：本题考查的是生物碱的分类。结构中氮原子不在环状结构内的生物碱是麻黄碱（A对）。有机胺类生物碱：结构特点是氮原子不在环状结构内，如麻黄中的麻黄碱，秋水仙中的秋水仙碱，益母草中的益母草碱等。槲皮素（B错）为银杏叶的主要化学成分，属于黄酮类化合物。小檗碱（C错）为黄连的主要化学成分，属于异喹啉类生物碱。东莨菪碱（D错）为洋金花的主要化学成分，属于莨菪烷类生物碱。青蒿素（E错）为青蒿的主要化学成分，属于倍半萜类化合物。